多发于骨骼或关节间等深部组织的化脓性疾病是
A. 疮疡
B. 肿疡
C. 溃疡
D. 有头疽
E. 无头疽

正确答案：E。无头疽

解析：疮疡广义上指一切体表外科疾患的总称，狭义指发于体表的化脓性疾病（A错）。肿疡指体表外科疾病尚未破溃的肿块（B错）。溃疡指一切外科疾病破溃的创面（C错）。有头疽是发生于肌肤间的急性化脓性疾病（D错）。无头疽是发生于骨与关节间的急性化脓性疾病的统称（E对）。